在男性，输尿管盆段在进入膀胱前，跨其前上方者为
A. 髂总血管
B. 髂内血管
C. 腰骶干
D. 输精管
E. 闭孔神经

正确答案：D。输精管

解析：男性输尿管进入膀胱前在输精管（D对）后外方与之交叉。